胎黄患婴，症见：目黄，身黄，黄色鲜明，哭闹不安，呕吐腹胀，尿黄便结，舌质红，苔黄腻，指纹紫滞者。宜选用
A. 茵陈蒿汤加味
B. 茵陈四苓散加味
C. 茵陈理中汤加味
D. 膈下逐瘀汤加减
E. 羚角钩藤汤合茵陈蒿汤加减

正确答案：A。茵陈蒿汤加味

解析：本病例已明确诊断胎黄，即新生儿黄疸。孕母内蕴湿热，传于胎儿，以致婴儿出生后受湿热的熏蒸，肝胆疏泄失常，胆汁外泄，浸淫面目肌肤而发黄，颜色鲜明；热扰心神，故哭闹不安；湿热内蕴，气机郁滞，胃失和降，故见呕吐腹胀；湿热壅结于大肠，故便结；湿热下注膀胱，故尿黄；舌质红，苔黄腻，均为湿热熏蒸之候，故其证候为湿热薰蒸证，治以清热利湿退黄，方药为茵陈蒿汤加味（A对）。茵陈四苓散（B错）其功用为利湿清热退黄，适用于黄疸之湿重于热证。茵陈理中汤（C错）其功用为温中化湿退黄，适用于胎黄之寒湿阻滞证。膈下逐瘀汤（D错）其功用为活血祛瘀，行气止痛，适用于瘀血阻滞膈下证。羚角钩藤汤合茵陈蒿汤（E错）其功用为平肝熄风，利湿退黄，适应于胎黄动风证。